幽门的位置在
A. 第11胸椎体的右侧
B. 第12胸椎体的左侧
C. 第12胸椎体的右侧
D. 第1腰椎体的左侧
E. 第1腰椎体的右侧

正确答案：E。第1腰椎体的右侧

解析：贲门在第11胸椎体左侧而幽门在第1腰椎体右侧(E对)。